下列说法中属于医疗机构需要承担赔偿责任的情形的是
A. 医疗水平难以诊疗
B. 医务人员在抢救生命垂危的患者等紧急情况下尽到合理诊疗义务
C. 患者或者其近亲属不配合医疗机构进行符合诊疗规范的诊疗
D. 医务人员尽到说明义务，造成患者损害的
E. 医务人员在诊疗活动中未尽到与当时的医疗水平相应的诊疗义务，造成患者损害

正确答案：E。医务人员在诊疗活动中未尽到与当时的医疗水平相应的诊疗义务，造成患者损害

解析：患者有损害，因下列情形之一的，医疗机构不承担赔偿责任：①患者或者其近亲属不配合医疗机构进行符合诊疗规范的诊疗；②医务人员在抢救生命垂危的患者等紧急情况下已经尽到合理诊疗义务；③限于当时的医疗水平难以诊疗。医务人员在诊疗活动中未尽到与当时的医疗水平相应的诊疗义务，造成患者损害；医务人员未尽到说明义务，造成患者损害的要承担赔偿责任。掌握“医疗损害责任”知识点。